在下列各项中，哪项不属于四诊中听声音的内容
A. 耳鸣
B. 咳嗽
C. 错语
D. 呃逆
E. 嗳气

正确答案：A。耳鸣

解析：耳鸣是指患者自觉耳内有响声如潮水或蝉鸣的症状，是患者自己的感觉，需要医者通过问诊来获得（A错，为本题正确答案）。咳嗽（B对）指有气上升至喉咙，声道关闭，突然开放发出的一种“咳、咳”声音；错语（C对）指患者神识清楚而语言时有错乱，说后自知言错者；呃逆（D对）指从咽喉发出的一种不由自主的冲击声，呃呃作响，声短而频，不能自制；嗳气（E对）指胃中气体上出咽喉所发出的一种声长而缓的症状，这些都是医生可以听见并且辨识的患者所发出的声音，都属于四诊中听诊的内容。